阎某，女性，39岁。汗出恶风，周身酸楚，时寒时热，失眠，脉缓，苔薄白，治疗应选用
A. 玉屏风散
B. 桂枝汤
C. 当归六黄汤
D. 龙胆泻肝汤
E. 再造散

正确答案：B。桂枝汤

解析：根据患者“汗出恶风，周身酸楚，时寒时热，失眠，脉缓，苔薄白”可诊断为汗证之营卫不和证，治疗时调和营卫，应选用桂枝汤加减（B对）。玉屏风散（A错）可以益气固表，用于治疗汗证之肺卫不固证证。当归六黄汤（C错）可以滋阴降火，固表止汗，用于治疗阴虚火旺之盗汗证。龙胆泻肝汤（D错）可以清肝泄热，化湿合营，治疗汗证之邪热郁蒸证。再造散（E错）可以助阳益气，散寒解表，用于治疗阳气虚弱，感冒风寒。